口腔临床感染的传播途径有
A. 经感染器械伤害传播
B. 经术者手部伤口传播
C. 飞沫传播
D. 以上均是
E. 以上均不是

正确答案：D。以上均是

解析：口腔临床感染的传播途径有①经污染器械伤害传播：污染器械刺伤是口腔医务人员的主要危险，针刺伤后乙肝感染的危险性为20%～25%，因此，在任何时候处理污染的针头及尖锐器械时都应十分谨慎。②经术者手部伤口传播：口腔医务人员感染HBV的机会为一般人群的5倍，很可能是经术者手的伤口感染。因此不戴手套操作对医生和患者都非常危险。③空气飞溅传播：由高速手机、气水枪、超声波洁牙机形成的飞沫通常直径为5μm或更小，微滴可悬浮在空气中很长一段时间，可经呼吸道进入支气管。因此口腔科医生、助手和洁牙员进行治疗时应戴面罩，诊断室应有较好的通风，患者治疗前应漱口，在牙科手术中，飞沫、碎片、污染的手和器械还可以导致手术区的广泛污染。诊室安装高速抽风机或定时紫外线灯照射消毒可减少飞沫污染。掌握“口腔医疗保健中的感染”知识点。